可以直接转变为谷氨酸的物质是
A. 乙酰乙酸
B. 丙二酸
C. 丙酮酸
D. α-酮戊二酸
E. 草酰乙酸

正确答案：D。α-酮戊二酸

解析：丙酮酸（C错）和谷氨酸在谷丙转氨酶作用下，直接转变为丙氨酸和α-酮戊二酸（D对），此反应可逆。乙酰乙酸（A错）、丙二酸（B错）、草酰乙酸（E错）均不可以直接转变为谷氨酸。